属于孕早期保健主要内容的是
A. 预防胎儿发育畸形
B. 指导产妇胎教
C. 筛查胎儿畸形
D. 预防妊娠并发症
E. 筛查妊娠并发症

正确答案：A。预防胎儿发育畸形

解析：本题考查孕早期保健主要内容。妊娠早期是胚胎及胎儿发育至关重要的时期，环境中各种有害因素将对胎儿的生长发育造成决定性的影响。妊娠早期保健的主要目的是确定宫内妊娠及孕周，预防胎儿发育畸形（A对BCDE错），全面评价孕妇与胎儿健康状况，筛查不宜妊娠者，提供孕产期保健指导。